支气管哮喘患者发作时禁用的药物是
A. 吗啡
B. 氨茶碱
C. 沙丁胺醇
D. 泼尼松
E. 肾上腺素

正确答案：A。吗啡

解析：吗啡（A对）对于哮喘没有明显缓解作用，大剂量还会加重哮喘。支气管哮喘发作时缓解药物有糖皮质激素（D错）、β₂受体激动剂（C错）、茶碱类药物（B错）。肾上腺素（E错）可以激动受体，可以使支气管扩张，缓解症状。